男，40岁。右上腹胀痛伴间断发热3个月。1年前曾因“腹泻、菌痢？”住院治疗后缓解。腹部B超示：肝右叶单发直径10cm囊肿。曾于粪便中发现有叶状伪足的滋养体。此病原体从肠道感染至肝的途径是
A. 从腹腔经淋巴系统入肝
B. 从胆道上行入肝
C. 从小肠经门静脉入肝
D. 从胃经门静脉入肝
E. 从结肠经门静脉入肝

正确答案：E。从结肠经门静脉入肝

解析：患者右上腹胀痛伴间断发热，腹部B超示：肝右叶单发直径1.5cm囊肿，在粪便中发现叶状伪足的滋养体，应诊断为阿米巴性肝脓肿。从肠道感染至肝的途径是从结肠经门静脉入肝（E对）。